下列不属于房室传导阻滞的症状或体征的是
A. 心源性脑缺氧综合征
B. 第一心音强度不等
C. 大炮音
D. 心律不规则
E. 第二心音可呈正常或反常分裂

正确答案：D。心律不规则

解析：房室传导阻滞的临床表现，一度房室阻滞病人通常无症状。二度房室阻滞可引起心搏脱漏，可有心悸症状，也可无症状。三度房室阻滞的症状取决于心室率的快慢与伴随病变，症状包括疲倦、乏力、头晕、晕厥、心绞痛、心力衰竭。房室阻滞因心室率过慢导致脑缺血，病人可出现暂时性意识丧失，甚至抽擂，称为心源性脑缺氧综合征综合征（A对），严重者可致猝死。一度房室阻滞听诊时，因PR间期延长，第一心音强度减弱。二度Ⅰ型房室阻滞第一心音强度逐渐减弱并有心搏脱漏。二度Ⅱ型房室阻滞亦有间歇性心搏脱涌，但第一心音强度恒定。三度房室阻滞因房室分离，第一心音强度经常变化（B对），第二心音可呈正常或反常分裂（E对），间或听到响亮亢进的第一心音（大炮音）（C对）（D错，为本题正确答案）。